河水取水点的防护带是
A. 上游100米至下游50米
B. 上游1000米至下游100米
C. 上游1000米至下游1000米
D. 上游50米至下游100米
E. 上游100米至下游1000米

正确答案：B。上游1000米至下游100米

解析：本题考查河水取水点的防护带。河水取水点的防护带是上游1000米至下游100米（B对ACDE错）。